下列各项，不属疔疮走黄原因的是
A. 麻疹余毒未清
B. 误食辛热之品
C. 早期失治
D. 挤压碰撞
E. 过早切开

正确答案：A。麻疹余毒未清

解析：走黄的病因病机：走黄的发生主要在于火毒炽盛，毒入营血，内功脏腑。生疔之后，早期失治（C对），不能控制毒势；或挤压碰伤（D对），过早切开（E对），疔毒虽未鸱张，得以直入营血；或误食辛热（B对）及酒肉鱼腥等发物，均可促使疔毒发散，入营入血，内攻脏腑而成走黄（A错，为本题正确答案）。